毒性药品标签（标志）的颜色规定由
A. 绿色、白色组成
B. 蓝色、白色组成
C. 黑色、白色组成
D. 红色、白色组成
E. 红色、黄色组成

正确答案：C。黑色、白色组成

解析：本题考查毒性药品标签上的标志。毒性药品标签（标志）的颜色规定由黑色、白色组成（C对）。国务院药品监督管理部门规定的医疗用毒性药品的标志颜色：黑白相间，黑底白字。根据《药品管理法》及相关规定，麻醉药品和精神药品的标签必须印有国务院药品监督管理部门规定的标志。国务院药品监督管理部门规定的麻醉药品专用标志样式为天蓝色与白色相间（B错）的图案，精神药品的专用标志样式为绿色与白色相间（A错）的图案。外用药品标识为红色方框底色内标注白色（D错）“外”字。放射性药品标签的颜色规定由红色、黄色组成（E错）。